根据《化学药品和治疗用生物制品说明书规范细则》，应列在【注意事项】项下的内容是
A. 药品可以预防的疾病
B. 服用药品对于临床检验的影响
C. 服用药品后出现皮疹，停药后可恢复
D. 禁止应用该药品的疾病情况
E. 该药品与其他药品合并用药的注意事项

正确答案：B。服用药品对于临床检验的影响

解析：本题考查药品说明书的编写要点。根据《化学药品和治疗用生物制品说明书规范细则》，应列在【注意事项】项下的内容是服用药品对于临床检验的影响（B对）。注意事项或禁忌：安全剂量范围小的药品必须标明此栏，注意事项还包括孕妇、哺乳期、慢性病等特殊患者应注意的内容，以及其他药品合用的禁忌等。药品可以预防的疾病（A错）应列在【适应症或功能主治】项下。服用药品后出现皮疹，停药后可恢复（C错）应列在【不良反应】项下。禁止应用该药品的疾病情况（D错）应列在【禁忌】项下。该药品与其他药品合并用药的注意事项（E错）应列在【药物相互作用】项下。